环境卫生学的研究中
A. 环境流行病学方法是最好的方法
B. 分子生物学方法是最好的方法
C. 环境毒理学方法是最好的方法
D. 健康危险度评价是最佳方法
E. 需要环境流行病学和环境毒理学相结合的方法

正确答案：E。需要环境流行病学和环境毒理学相结合的方法

解析：本题考查环境卫生学的相关内容。环境卫生学的研究任务需要环境流行病学和环境毒理学方法相结合（E对ABCD错）。以现代环境卫生学的观点，在研究环境因素特别是环境污染物的健康效应时，应采用宏观与微观相结合的研究方法。宏观研究是应用环境流行病学的方法，微观研究主要是采用环境毒理学的方法。